将处方部分药材细粉与其余药料制得的稠膏经加工制成的中药片剂称为
A. 提纯片
B. 全粉末片
C. 分散片
D. 全浸膏片
E. 半浸膏片

正确答案：E。半浸膏片

解析：本题考查的是中药片剂的类型。将处方部分药材细粉与其余药料制得的稠膏经加工制成的中药片剂称为半浸膏片（E对）。中药片剂的类型：中药片剂按照片剂原料及制法特征，可分为以下三种类型。（1）全浸膏片（D错）：系指将处方全部饮片提取制得的浸膏制成的片剂。（2）半浸膏片：系指将处方部分饮片细粉与其余药料制得的稠膏混合制成的片剂。（3）全粉末片（B错）：系指将处方中全部饮片粉碎成细粉，加适宜辅料制成的片剂。分散片（C错）：系指在水中能迅速崩解并均匀分散的片剂。分散片中的原料药物应是难溶性的，另加高效崩解剂及亲水性高黏度溶胀辅料制成。分散片可加水分散后口服，也可将分散片含于口中吮服或吞服。提纯片（A错），2022年考试指南未明确说明。